无系膜存在
A. 十二指肠
B. 阑尾
C. 横结肠
D. 空、回肠
E. 乙状结肠

正确答案：A。十二指肠

解析：十二指肠(A对)上无系膜存在，阑尾(B错)上有阑尾系膜，横结肠(C错)由横结肠系膜连于腹后壁，空、回肠(D错)由肠系膜连于腹后壁，乙状结肠(E错)由乙状结肠系膜连于盆腔左后壁。